HOCl和OCl⁻杀菌效果比较
A. HOCl的杀菌效果与OCl⁻相同
B. HOCl的杀菌效果比OCl⁻高80倍
C. HOCl的杀菌效果比OCl⁻低80倍
D. HOCl的杀菌效果比OCl⁻高50倍
E. HOCl的杀菌效果比OCl⁻低50倍

正确答案：B。HOCl的杀菌效果比OCl⁻高80倍

解析：本题考查HOCl和OCl⁻杀菌效果比较。次氯酸是弱电解质，在水中按下式离解：HOCl⇄H⁺＋OCl⁻。其离解程度与水温和pH有关。根据对大肠杆菌的实验，HOCl的杀菌效率比OCl⁻高约80倍（B对ACDE错）。